患者，男，24岁，近3年来反复餐后3～4小时上腹痛，持续至下次进餐后才缓解。应首先考虑的是
A. 消化性溃疡
B. 胃癌
C. 慢性胃炎
D. 胃肠神经官能症
E. 胆囊炎

正确答案：A。消化性溃疡

解析：患者饥饿时腹痛，进食时缓解，可能为十二指肠溃疡（A对）。早期胃癌的症状一般为慢性胃病的症状，胃痛、胃酸、烧心、胃胀，甚至有的病人出现一过性的呕吐，后期的病人才会表现为呕血和黑便（B错）。慢性胃炎大多数患者常无症状或有程度不等的消化不良症状，如上腹隐痛、食欲减退、餐后饱胀、反酸、恶心等（C错）。胃肠神经官能症如果表现在胃方面，一般常见症状有胃疼、胃胀、烧心、反酸、恶心、呕吐等，如果表现在肠道，可以出现肚子疼、肚子胀、肚子咕噜噜响、腹泻、便秘，可以伴随有排便不尽感、黏液便、肛门下坠（D错）。胆囊炎或胆石症疼痛可由进食油腻食物诱发，一旦急性起病，上腹痛症状剧烈，病期发展迅速，需要急诊就医（E错）。